患者，女，72岁，有青霉素过敏史。主诉尿痛、尿频，尿常规检查示大量白细胞，尿细菌数>10⁵cfu/ml，诊断为急性膀胱炎。应选用的药物是
A. 复方磺胺甲噁唑片
B. 莫西沙星片
C. 阿莫西林胶囊
D. 阿奇霉素片
E. 米诺环素片

正确答案：A。复方磺胺甲噁唑片

解析：本题考查复方磺胺甲噁唑片。应选用的药物是复方磺胺甲噁唑片（A对）。急性膀胱炎的短程疗法：磺胺类、喹诺酮类、半合成青霉素类、头孢菌素类，停服抗菌药7天后，尿细菌培养，结果阴性表示急性细菌性膀胱炎已治愈，如仍有菌尿，应继续给予2周抗菌药物治疗。莫西沙星片（B错）用于治疗成人（≥18岁）敏感细菌所引起的下列感染：急性细菌性鼻窦炎、慢性支气管炎急性发作、社区获得性肺炎、非复杂性皮肤和皮肤组织感染、复杂性皮肤和皮肤组织感染、复杂性腹腔内感染、鼠疫、不伴有输卵管-卵巢或盆腔脓肿的轻至中度盆腔炎性疾病等。妊娠期尿路感染时可选用阿莫西林（C错）、呋喃妥因或头孢菌素类等。阿奇霉素片（D错）用于敏感细菌所引起支气管炎、肺炎、急性中耳炎、鼻窦炎、咽炎、扁桃体炎、皮肤和软组织感染等。米诺环素片（E错）用于敏感菌引起的各类疾病，如败血症、梅毒、尿道炎、支气管炎等。